烟碱的结构类型是
A. 简单吡啶类
B. 简单莨菪碱类
C. 简单嘧啶类
D. 简单异喹啉类
E. 简单吲哚类

正确答案：A。简单吡啶类

解析：本题考查的是生物碱的分类。烟碱的结构类型是简单吡啶类（A对）。简单吡啶类生物碱：此类生物碱分子较小，结构简单，很多呈液态。如槟榔中的槟榔碱、槟榔次碱，烟草中的烟碱，胡椒中的胡椒碱等。莨菪烷类生物碱（B错）：多来源于鸟氨酸，由莨菪烷环系的C₃-醇羟基与有机酸缩合成酯。主要存在于茄科的颠茄属、曼陀罗属、莨菪属和天仙子属。重要化合物有莨菪碱、古柯碱等。简单异喹啉类（D错）生物碱：如鹿尾草中的降血压成分萨苏林，是四氢异喹啉的衍生物。简单嘧啶类生物碱（C错），2022年考试指南未明确说明。